肢体浅感觉的2级神经元位于
A. 脊神经节
B. 内侧丘系
C. 白质前联合
D. 脊髓后角
E. 薄束核

正确答案：D。脊髓后角

解析：肢体浅感觉的第1级神经元位于脊神经节内，周围突构成脊神经的感觉纤维，然后从后根外侧部的中枢突进入位于脊髓后角2级神经元（D对ABCE错）。